对精神障碍患者实施住院治疗须经监护人同意的情形是
A. 医疗费用需要自理
B. 没有办理住院手续能力
C. 发生伤害自身行为
D. 患者家属提出医学鉴定要求
E. 没有危害他人安全危险

正确答案：C。发生伤害自身行为